长期大剂量应用糖皮质激素可引起的不良反应是
A. 高血钾
B. 高血钙
C. 高血糖
D. 低血压
E. 以上均非

正确答案：C。高血糖

解析：糖皮质激素对于维持血糖正常水平以及肝脏、肌肉糖原含量有重要作用，可促进糖原异生，减慢葡萄糖分解，减少机体组织对葡萄糖的利用，引起长期使用糖皮质激素可引起机体糖代谢紊乱，引起高血糖（C对E错）。糖皮质激素与盐皮质激素有相似的保钠排钾作用，可通过增加肾小球滤过率和拮抗抗利尿激素，减少肾小管对水的重吸收，产生利尿作用，长期大剂量引起水盐代谢紊乱，钾排出量增加，出现血钾降低（A错），可加用氯化钾减轻症状。糖皮质激素还能促进肾脏对钙的排出，抑制小肠对钙的吸收，长期使用可引起低血钙（B错），导致骨质疏松，可采用高蛋白饮食减轻症状。长期大剂量使用糖皮质激素可引起医源性肾上腺皮质功能亢进症，可引起血压升高（D错），可用降压药减轻症状。